最易诱发中毒性巨结肠的电解质紊乱是
A. 低钾血症
B. 高钙血症
C. 低钠血症
D. 低钙血症
E. 低磷血症

正确答案：A。低钾血症

解析：中毒性巨结肠常因低钾（A对）、钡剂灌肠、使用抗胆碱能药物或阿片类制剂而诱发。高钙血症（B错）主要表现为头痛、背和四肢疼痛等；低钠血症（C错）主要表现为恶心、呕吐、头晕、视觉模糊、软弱无力、血压下降等；低钙血症（D错）主要表现为口周和指（趾）尖麻木及针刺感、手足抽搐等；低磷血症（E错）可出现头晕、厌食、肌无力、抽搐、昏迷等；均不会引起中毒性巨结肠。